以下关于桩核冠的说法错误的是
A. 桩的长度要尽可能的大于等于临床冠的长度
B. 固位力取决于摩擦力和粘结力
C. 桩核不能增强牙根的强度
D. 修复前必须行完善的根充
E. 桩核冠修复可减少根尖病变的发生

正确答案：E。桩核冠修复可减少根尖病变的发生

解析：桩核冠是一种修复体，不能减少根尖病变的发生。掌握“桩核冠”知识点。